染色体畸变有
A. 颠换
B. 置换
C. 转换
D. 互换

正确答案：D。互换

解析：本题考查染色体畸变。染色体畸变是指染色体的结构改变，是遗传物质较大范围的改变，是染色体或染色单体断裂及断裂的不正确重接所致。如染色单体的对称互换和不对称互换（D对）。颠换（A错）、置换（B错）、转换（C错）属于基因突变。